某企业针对职工个人卫生习惯较差，参加体育锻炼的人数很少，导致因病缺勤率高的问题，为职工增设了淋浴设备，购置了体育器材，保证职工有淋浴和体育锻炼时间，结果职工体质增强，出勤率提高，此措施属于健康促进的
A. 教育策略
B. 环境策略
C. 资源策略
D. 政策策略
E. 团体策略

正确答案：B。环境策略